上列各项中，能体现医生恪守尊重原则的是
A. 同情患者
B. 对待患者一视同仁
C. 保守患者的秘密和隐私
D. 选择对患者、对社会均有利的医疗卫生保健措施
E. 在诊治活动中杜绝有意和责任性伤害

正确答案：C。保守患者的秘密和隐私

解析：尊重原则是指医务人员对患者人格尊严和自主性的尊重。患者的秘密和隐私涉及个人的私人领域，属于自主权范围。因此，医生保守患者的秘密和隐私体现了医生恪守尊重原则。掌握“医学伦理的基本原则”知识点。